具有低溶解度、高渗透性，可通过增加溶解度和溶出速度的方法来改善吸收的药物是
A. 其他类药物
B. 生物药剂学分类系统（BCS）Ⅰ类药物
C. 生物药剂学分类系统（BCS）Ⅳ类药物
D. 生物药剂学分类系统（BCS）Ⅲ类药物
E. 生物药剂学分类系统（BCS）Ⅱ类药物

正确答案：E。生物药剂学分类系统（BCS）Ⅱ类药物

解析：本题考查生物药剂学分类。具有低溶解度、高渗透性，可通过增加溶解度和溶出速度的方法来改善吸收的药物是生物药剂学分类系统(BCS）Ⅱ类药物（E对）。生物药剂学分类系统根据药物溶解性和肠壁渗透性的不同组合将药物分为四类（A错）：（1）第Ⅰ类药物（B错）具有高溶解度、高渗透性，限速过程为胃排空速率。（2）第Ⅱ类药物具有低溶解度、高渗透性，限速过程为肠内溶出速率。（3）第Ⅲ类药物（D错）具有高溶解度、低渗透性，药物的跨膜转运是药物吸收的限速过程（4）第IV类药物（C错）具有低溶解度、低渗透性，其体内吸收比较困难。